合成血红素的原料是
A. 乙酰CoA、甘氨酸、Fe³⁺
B. 琥珀酰CoA、甘氨酸、Fe²⁺
C. 乙酰CoA、甘氨酸、Fe²⁺
D. 丙氨酰CoA、组氨酸、Fe²⁺
E. 草酰CoA、丙氨酸、Fe²⁺

正确答案：B。琥珀酰CoA、甘氨酸、Fe²⁺

解析：合成血红素的原料是琥珀酰CoA、甘氨酸、Fe²⁺（B对）。